引起小儿外感咳嗽最常见的病因是
A. 风
B. 寒
C. 暑
D. 湿
E. 燥

正确答案：A。风

解析：风为百病之长，四季均可见，风邪致病，首犯肺卫，清肃失司，肺气上逆，最常致咳嗽（A对）。